血液的pH平均约为
A. 7.10±0.05
B. 7.20±0.05
C. 7.40±0.05
D. 7.60±0.05
E. 7.80±0.05

正确答案：C。7.40±0.05

解析：血液的pH为7.40±0.05。掌握“血液成分及血浆蛋白”知识点。